陶瓷容器中可能移入食品的有害金属是
A. 铅、镉
B. 铁、锌
C. 铜、钴
D. 钼、镍
E. 铬、锡

正确答案：A。铅、镉